不属消法适应范围的是
A. 消食
B. 止血
C. 化痰
D. 行气
E. 利水

正确答案：B。止血

解析：本题考查消法的适应症。消法是行气活血不是止血（B对）。消法有消食（A错）导滞、行气（D错）活血、化痰（C错）利水（E错）、驱虫等方法。